关于阴茎海绵体正确的描述是
A. 为两端粗中间细的圆柱体
B. 前端膨大为阴茎头
C. 后端膨大为尿道球
D. 尿道外口开口于其顶端
E. 后端左右分开，称为阴茎脚

正确答案：E。后端左右分开，称为阴茎脚

解析：阴茎海绵体为两端尖细（A错）的圆柱体。尿道海绵体（B错）前端膨大为阴茎头。尿道海绵体（C错）后端扩大为尿道球。尿道外口开口于阴茎头（D错）的顶端。阴茎海绵体后端左右分开，称阴茎脚（E对）。